一正常发育小儿，男，身高96cm，体重16kg。该小儿的年龄是
A. 婴儿期
B. 幼儿期
C. 幼童期
D. 儿童期
E. 新生儿期

正确答案：C。幼童期

解析：小儿出生时身长平均约为50cm，1岁时约为75cm，2岁时约为85cm；体重平均3kg，1岁时约为9kg，2岁时约为12kg，本题男孩身高96cm，体重16kg，大致估算年龄>2岁，故可以运用上述公式，96=7×年龄+70，16=8+2×年龄，计算得到3.71岁≤年龄≤4岁，故属于学龄前期，即幼童期（C对）。婴儿期（A错）为出生后28天后至1周岁。幼儿期（B错）为1～3周岁。儿童期（D错）为总称，分为围产期、新生儿期、婴儿期、幼儿期、学龄前期、学龄期和青春期。新生儿期（E错）为出生后脐带结扎开始，至生后满28天。